下列哪个部位的淋巴不注入腹股沟浅淋巴结
A. 腹前壁下部
B. 臀部
C. 会阴部
D. 外生殖器
E. 小腿后外侧

正确答案：E。小腿后外侧

解析：腹股沟浅淋巴引流引流腹前外侧壁下部（A对）、臀部（B对）、会阴部（C对）、外生殖器（D对）和子宫底淋巴，并不包括小腿外侧部。腿外侧部淋巴由腘淋巴管收纳而后注入腹股沟深淋巴（E错，为本题正确答案）。